青少年牙周炎牙齿的松动、移位最为明显的是
A. 下颌前磨牙
B. 下颌磨牙
C. 下颌前牙
D. 上颌磨牙
E. 上颌前牙

正确答案：E。上颌前牙

解析：本题考查局限型侵袭性牙周炎的临床表现。青少年牙周炎牙齿的松动、移位最为明显的是上颌前牙（E对）。青少年牙周炎患牙出现松动，切牙可向唇侧远中移位，呈扇形散开排列，出现牙间隙，多见于上切牙。青少年牙周炎的牙槽骨吸收局限于第一恒磨牙和上切牙（AC错）。单根牙比多根牙容易松动（BD错）。